具有抗炎平喘作用，用于防治慢性支气管炎症，最终消除哮喘症状的药物是
A. 氯喹
B. 青蒿素
C. 甲硝唑
D. 青霉素
E. 糖皮质激素

正确答案：E。糖皮质激素

解析：糖皮质激素具有抗炎平喘作用，用于防治慢性支气管炎症，最终消除哮喘症状。掌握“平喘药”知识点。